男，72岁，10小时前突发昏迷。CT诊断为脑出血，2小时前胃管引流出咖啡色液体约50毫升，其上消化道出血最可能的原因是
A. 缺血性胃病
B. 胆汁反流性胃炎
C. 感染引起急性胃粘膜病变
D. 药物性胃炎
E. 应激引起急性胃粘膜病变

正确答案：E。应激引起急性胃粘膜病变

解析：患者为老年男性，10小时前突发昏迷，CT诊断为脑出血，胃管引流出咖啡色液体约50毫升（提示上消化道出血），该患者应考虑为脑出血后引起的应激性溃疡，表现为急性胃粘膜病变（E对）。颅内出血后，交感神经兴奋，肾上腺髓质分泌儿茶酚胺增多，使胃黏膜下血管发生挛缩性收缩，组织灌流量显著下降，导致胃粘膜缺血、缺氧，以至于发生表浅的、边缘平坦的溃疡或大小不等的糜烂灶，导致上消化道出血。缺血性胃病（A错）常有胃痛、胃胀等胃部不适病史。胆汁反流性胃炎（B错）常有恶心，腹胀，恶心与呕吐，消瘦，体重减轻等症状。感染引起急性胃粘膜病变（C错）常有感染前驱病史，不符题意。药物性胃炎（D错）常有服用非甾体抗炎药病史，患者并没有相关病史。